逍遥散加味适用于乳腺增生病的哪种证型
A. 冲任失调
B. 肝郁气滞
C. 痰瘀凝结
D. 肝脾不和
E. 肝肾不足

正确答案：B。肝郁气滞

解析：逍遥散的功效是疏肝解郁，养血健脾，逍遥散中加入理气药后可适用于肝郁气滞证，故逍遥散加味适用于乳腺增生病的肝郁气滞证（B对）。冲任失调证应用二仙汤合四物汤加减治疗（A错）。